胆囊呈梨形，位于胆囊窝内，胆囊分为胆囊底、胆囊体、胆囊颈和胆囊管4部分，有浓缩和储存胆汁的功能。胆囊的形态和位置，正确的是
A. 属腹膜内位器官
B. 分底、体、颈3部
C. 胆囊颈和胆囊管的黏膜形成螺旋襞
D. 上面借结缔组织与肝左叶相连
E. 胆囊动脉来自肠系膜上动脉的分支

正确答案：C。胆囊颈和胆囊管的黏膜形成螺旋襞

解析：胆囊属腹膜间位器官(A错)，分底、体、颈、管4部(B错)，胆囊颈和胆囊管黏膜突入腔内形成螺旋襞(C对)，上面借结缔组织与肝相连，位于肝方叶与肝右叶之间(D错)，胆囊动脉来自肝固有动脉的分支(E错)。